病例对照研究中，估计样本大小时，与下列哪一因素无关
A. 研究因素在对照人群中的估计暴露率
B. 研究因素估计比值比
C. 研究疾病的发病率
D. 希望达到的检验显著性水平
E. 希望达到的检验把握度

正确答案：C。研究疾病的发病率